蛋白质分子中不存在的氨基酸是
A. 半胱氨酸
B. 赖氨酸
C. 鸟氨酸
D. 脯氨酸
E. 组氨酸

正确答案：C。鸟氨酸

解析：本题考查氨基酸与多肽及蛋白质结构。蛋白质分子中存在的氨基酸分为人体必需氨基酸、非必需氨基酸。鸟氨酸（C错，为本题正确答案）是不存在的。